属于温室效应气体是
A. CO
B. SO₂
C. H₂S
D. HCl
E. CH₄

正确答案：E。CH₄

解析：本题考查温室效应气体。大气层中某些气体能吸收地表发射的热辐射，使大气增温，称为温室效应。这些气体统称为温室气体，主要包括CO₂、甲烷（CH₄）（E对ABCD错）、氧化亚氮（N₂O）和氯氟烃（CFC）等。